月经先后无定期，经来量少，色淡暗，质稀，头晕耳鸣，腰骶酸痛。治疗应首选
A. 固阴煎
B. 六味地黄丸
C. 大补元煎
D. 左归丸
E. 归肾丸

正确答案：A。固阴煎

解析：患者月经先后无定期诊断为月经先后无定期。经来量少，色淡暗，质稀诊断为虚证。头晕耳鸣，腰骶酸痛诊断为肾虚证，因此治疗当补肾调经，固阴煎的功效为补肾益气，固冲调经，为月经先后无定期 肾虚证的首选方（A对）。六味地黄丸的功效为滋补肝肾，主治肝肾阴虚证（B错）。大补阴丸的功效为滋阴降火，主治阴虚火旺证（C错）。左归丸的功效为滋阴补肾，填精益髓，主治真阴不足证（D错）。归肾丸的功效为滋阴养血，填精益髓，主治肾水不足证（E错）。